关于医学实践与医学伦理学的关系，下述提法中错误的是
A. 医学实践是医学伦理学的理论指导
B. 医学实践是医学伦理学的基础
C. 医学实践是医学伦理学的动力
D. 医学实践是医学伦理学的目的
E. 医学实践是检验医学伦理学的唯一标准

正确答案：A。医学实践是医学伦理学的理论指导